男性，28岁。因患精神分裂症，服用氯丙嗪。今天因过量服用该药而出现昏迷，被送入院。查体：血压70/32mmHg（9.3/4.3kPa）。抢救中应使用的升压药是
A. 肾上腺素
B. 异丙肾上腺素
C. 去甲肾上腺素
D. 多巴胺
E. 多巴酚丁胺

正确答案：C。去甲肾上腺素

解析：患者男性，患有精神分裂症，因服用过量氯丙嗪而出现昏迷，查体血压70/32mmHg（正常值90～139/60～89mmHg，提示有低血压休克），抢救中应使用的升压药是去甲肾上腺素（C对），其激动α受体作用强大、对β2受体几乎无作用，能使外周血管收缩，增加外周血管阻力，从而有效升高血压。氯丙嗪（八版药理学P143）能拮抗α肾上腺素受体（与血管收缩有关），但不拮抗β肾上腺素受体（与血管舒张有关），大量氯丙嗪中毒时，若再给予能激动β受体的升压药，会进一步舒张外周血管，加重病情。肾上腺素（八版药理学P81）（A错）激动α、β受体、异丙肾上腺素（八版药理学P84）（B错）激动β受体，多巴胺（八版药理学P82）（D错）激动α、β和外周DA受体，以上药物和氯丙嗪共同作用时，不仅无升压效果反而使血压下降。多巴酚丁胺（八版药理学P85）（E错）是含有右旋多巴酚丁胺和左旋多巴酚丁胺的消旋体，前者阻断α1受体，后者激动α1受体，两者相互抵消，因此药物本身升压效果不好。